癫痫患者服用抗癫痫药最切忌
A. 用药剂量太小
B. 同时合用两种药
C. 只在夜间服
D. 药物价格太高
E. 突然停药

正确答案：E。突然停药

解析：癲痫患者服用抗癲痫药最切忌突然停药（E对），	抗癫痫药物控制癫痫发作后，除非出现严重的不良反应，必须坚持长期服用，不宜随意减量或停药，突然停药可诱发癫痫持续状态，可有生命危险，故后果最为严重。用药剂量太小（A错）可能疗效不佳，但不会有太严重的后果。合理的多药联合（B错）治疗在最低程度增加不良反应的前提下，可获得最大限度的发作控制，一定情况下推荐联合用药。倡导较大剂量于睡前服用减少白天的镇静作用，但还应配合白天小剂量服药，提高有效血药浓度持续时间，而不是只在夜间服（C错）药。药物价格太高（D错）会给患者带来经济压力，但不是癲痫患者服用抗癲痫药最切忌的事情。